某人做事总是风风火火，速度很快，脾气暴躁，缺乏耐性，而且时不时会出些错误。其气质类型属于
A. 胆汁质
B. 多血质
C. 黏液质
D. 多动质
E. 抑郁质

正确答案：A。胆汁质

解析：古希腊著名医生希波克拉底提出体质体液学说，他认为人体内有血液、黏液、黑胆汁和黄胆汁四种液体，根据在人体内四种体液的不同比例将气质分为多血质、胆汁质、黏液质和抑郁质。（1）多血质（B错）：注意力容易转移，志趣容易变化，灵活好动，有较生动的面部表情和语言表达能力，感染力较强，直爽热情，容易适应环境的变化。活动中行动敏捷，精力充沛。（2）胆汁质（A对）：动作迅速，情绪易于冲动，自我控制能力较差，心境变化大。活动中缺乏耐心，可塑性差。（3）黏液质（C错）：安静稳重，注意力稳定但难以转移，喜怒不形于色。动作反应慢，不灵活，对工作有条理，易于因循守旧，缺乏创新精神。（4）抑郁质（E错）：对事物体验深刻，善于觉察他人难以发现的细小环节，对事物和他人羞怯，孤僻内向。动作迟钝，多愁善感。分类中无多动质（D错）。